麻黄汤中配伍炙甘草的主要用意是
A. 益气补虚
B. 扶正祛邪
C. 缓峻护正
D. 化痰止咳
E. 发汗祛湿

正确答案：C。缓峻护正

解析：麻黄汤的功用为发汗解表，宣肺平喘。炙甘草甘，平；归心、肺、脾、胃经。可补脾益气，祛痰止咳，缓急止痛，清热解毒，调和诸药。麻黄汤方中使以炙甘草，既调和药性，又缓麻、桂峻烈之性，使汗出而不致耗伤正气（C对）。